男，5岁。上腹痛1周，伴发热、少尿3天。查体：T39.5℃，P110次/分，R22次/分，BP85/50mmHg。表情淡漠，皮肤、巩膜轻度黄染。腹部膨隆，右上腹压痛（﹢），轻度肌紧张和反跳痛。肠鸣音减弱。实验室检查：Hb110g/L，WBC15.0×10⁹/L，N0.92。血Cr59μmol/L。此时首要的处理措施是
A. 剖腹探查
B. 应用利尿药
C. 应用强心药
D. 补充血容量
E. 抗生素治疗

正确答案：D。补充血容量

解析：患儿腹痛、高热（39.1℃～41℃称高热）、黄疸（皮肤、黏膜、巩膜发黄），有腹膜刺激征（腹部压痛、反跳痛及肌紧张）。患者低血压（血压低于90/60mmHg称为低血压）且表情淡漠提示出现休克。实验室检查：Hb110g/L偏低（Hb即血红蛋白，6个月到＜6岁儿童Hb正常值为120～140g/L，低于110g/L为贫血），WBC（正常值为4～10×l0^9/L）升高、N（N即中性粒细胞，正常百分率为0.5～0.7）升高提示感染，血Cr正常（Cr即肌酐，儿童正常全血肌酐应为25～70μmol/L）提示肾功能良好。综上，该患者应诊断为腹膜炎引发的感染性休克。感染性休克多由急性腹膜炎、胆道感染等引起，致病菌多为革兰阴性杆菌，可释放内毒素入血引发毒血症，常表现为高热、黄疸、心率加快、呼吸急促、白细胞明显升高等症状。感染性休克的治疗原则是：休克纠正前首先补充血容量纠正休克（D对），而后着重抗生素治疗（E错）控制感染。剖腹探查（A错）常用于外伤或急腹症的明确诊断及治疗。患者虽然尿少，但血Cr正常，说明肾功能良好，血容量补足及病因纠正以后尿量可以恢复不必应用利尿剂（B错）。患者的血压低、尿少等症状是由于感染性休克引发的，纠正休克后自然好转，无需应用强心药（C错）。